关于甲亢患者术前准备服用碘剂的作用，错误的是
A. 抑制甲状腺素的合成
B. 使甲状腺缩小变硬
C. 抑制甲状腺素释放
D. 可以减少甲状腺的血流量
E. 抑制蛋白水解酶，减少甲状腺球蛋白的分解

正确答案：A。抑制甲状腺素的合成

解析：甲状腺球蛋白水解时，需足够的还原型谷胱甘肽来还原甲状腺球蛋白中的二硫键。术前应用碘剂可抑制谷胱甘肽还原酶，减少谷胱甘肽，从而抑制蛋白水解酶，减少甲状腺球蛋白的分解（E对），抑制甲状腺素释放（C对）。碘剂还可以减少甲状腺的血流量（D对），使甲状腺缩小变硬（B对）。但碘剂只能抑制甲状腺素的释放，而不能抑制其合成（A错，为本题正确答案），一旦停服碘剂后，贮存于甲状腺滤泡内的甲状腺球蛋白大量分解，甲亢症状可重新出现，甚至比原来更为严重。